男，60岁，进食哽噎感2月余。上消化道X线钡剂造影示中段食管管壁充盈缺损，为明确诊断，应首选的检查是
A. 胸部CT
B. 胸部X线片
C. 胃镜
D. PET-CT
E. 食管拉网细胞学检查

正确答案：C。胃镜

解析：老年男性患者，进食哽噎感（食管癌的典型症状），X线钡剂造影示中段食管管壁充盈缺损，考虑诊断为食管癌。为明确诊断，应首选的检查是胃镜（C对）。